既开窍宁神，又化湿和胃的药是
A. 郁金
B. 牛黄
C. 蟾酥
D. 草豆蔻
E. 石菖蒲

正确答案：E。石菖蒲

解析：本题考查的是石菖蒲的功效。既开窍宁神，又化湿和胃的药是石菖蒲（E对）。石菖蒲：【功效】开窍宁神，化湿和胃。郁金（A错）：【功效】活血止痛，行气解郁，凉血清心，利胆退黄。牛黄（B错）：【功效】清热解毒，息风止痉，化痰开窍。蟾酥（C错）：【功效】解毒消肿，止痛，开窍醒神。草豆蔻（D错）：【功效】燥湿行气，温中止呕。